牙髓活力电测验常用于诊断
A. 牙髓钙化
B. 牙髓炎症
C. 急性根尖周炎
D. 牙髓坏死
E. 慢性根尖周炎

正确答案：D。牙髓坏死

解析：本题考查牙髓点活力测验法。牙髓电活力测验是通过牙髓活力测验仪来检测牙髓神经成分对电刺激的反应，主要用于判断牙髓“生”或“死”的状态。若被测牙牙髓存在反应，表示牙髓还有活力；若被测牙无反应，说明牙髓已坏死（D对）。牙髓钙化时，牙髓的血液循环发生障碍，出现钙盐沉积，牙髓活力异常，但仍有一定活力，牙髓电活力测验阳性（A错）。牙髓炎症有时尚有部分活髓，牙髓电活力侧验阳性（B错）。急性根尖周炎（C错）、慢性根尖周炎（E错）有时炎症未累及根尖处的牙乳头，牙髓电活力测验呈阳性。